心房和心室在心表面的分界结构为
A. 前室间沟
B. 后室间沟
C. 冠状沟
D. 室间隔
E. 界嵴

正确答案：C。冠状沟

解析：冠状沟（C对）为心房和心室在心表面的分界结构，几乎呈额状位，近似环形，前方被肺动脉干所中断。